据统计，合并用药6～10种，不良反应的发生率大约是
A. 0.001
B. 0.01
C. 0.04
D. 0.07
E. 0.1

正确答案：E。0.1